患者腹内积块明显，硬痛不移，面暗消瘦，纳食减少，时有寒热，舌紫暗有瘀斑，脉细涩。其证候是
A. 肝气郁滞
B. 食滞痰阻
C. 气滞血阻
D. 瘀血内结
E. 正虚瘀结

正确答案：D。瘀血内结

解析：题中患者以腹内积块明显，硬痛不移为主症，故诊断为积聚。聚证望之有形，按之无块，聚散无常，痛无定处，积证望之可无形，但触之必见结块，且固定不移，痛有定处，故题中为积证。腹内积块明显，硬痛不移为瘀血凝结于内所致；血瘀不能华色，不能濡养肌肤，故面暗消瘦；肝病及脾，故纳食减少；瘀血结于内，病在血分，故时有寒热；舌紫暗有瘀斑，脉细涩，均为瘀血内结之象，故辨为瘀血内结证。肝气郁滞为聚证的证型（A错）。食滞痰阻为聚证的证型（B错）。气滞血阻为胀痛，腹内积块质软不坚，瘀象不明显（C错）。题中辨为瘀血内结证（D对）。正虚瘀结多为隐痛或剧痛，肌肉削瘦，面色萎黄或黧黑，可有浮肿（E错）。